关于白斑的发病因素下列哪项说法是正确的
A. 戒烟可导致白斑
B. 咀嚼槟榔可导致白斑
C. 菌斑刺激可导致白斑
D. 白斑有家族遗传倾向
E. 免疫低下可造成白斑

正确答案：B。咀嚼槟榔可导致白斑

解析：本题考查白斑的发病因素。白斑的发病因素正确的是咀嚼槟榔可导致白斑（B对）。口腔白斑病是发生于口腔黏膜上以白色为主的损害，不能擦去，也不能以临床和组织病学的方法诊断为其他可定义的损害。烟草是口腔白斑病发病的重要因素（A错）。食用过烫或酸辣食物、咀嚼槟榔等局部理化刺激也与口腔白斑病的发生有关。白斑无遗传倾向（D错），和免疫（E错）及菌斑（C错）无关。